肉类罐头高温灭菌时，下列哪种营养素损失最多
A. 蛋白质
B. 脂肪
C. 钙
D. B族维生素
E. 铁

正确答案：D。B族维生素